属于芳香氨酶抑制剂的抗肿瘤药是
A. 炔雌醇
B. 他莫昔芬
C. 阿那曲唑
D. 丙酸睾酮
E. 氟他胺

正确答案：C。阿那曲唑

解析：本题考查抗肿瘤药。阿那曲唑（C对）是芳香氨酶抑制剂。炔雌醇（A错）是雌激素类抗肿瘤药。他莫昔芬（B错）是雌激素受体拮抗剂。丙酸睾酮（D错）是雄激素类抗肿瘤药。氟他胺（E错）是非甾体的雄激素拮抗剂。